小儿肺炎喘嗽心阳虚衰证的主要发病机理是
A. 肾阳虚损，心阳不振
B. 气滞血瘀，心阳不振
C. 肺气虚衰，心阳不振
D. 脾阳虚损，心阳失养
E. 肺气郁闭，百脉失养

正确答案：B。气滞血瘀，心阳不振

解析：小儿肺炎喘嗽心阳虚衰证常出现于婴幼儿，或素体虚弱而患肺炎喘嗽者，即邪盛正虚患儿，来势急，病情重。由于邪毒炽盛，损伤原本不足之心阳，肺闭气郁导致血滞而络脉瘀阻，故本证的主要病机为气滞血瘀，心阳不振（B对）。